女，65岁。夜尿增多3年，乏力4个月。曾服用“龙胆泻肝丸”5年。查体：BP145/90mmHg，贫血貌。实验室检查：血Hb74g/L，SCr220µmol/L，尿比重1.010，尿糖（+）尿蛋白（＋），尿RBC2~3/HP。B超示双肾萎缩。其肾功能减退最主要的原因是
A. 慢性肾盂肾炎
B. 慢性间质性肾炎
C. 慢性肾小球肾炎
D. 糖尿病肾病
E. 高血压肾损害

正确答案：B。慢性间质性肾炎

解析：患者老年女性，曾服用“龙胆泻肝丸”5年（慢性间质性肾炎病因），夜尿增多3年（提示肾小管功能下降）。实验室检查：血Hb74g/L（肾性贫血，提示肾间质病变），SCr220µmol/L（升高，正常值为88.4～176.8mmol/L），尿比重1.010（低比重尿），尿糖（+）尿蛋白（＋），尿RBC2～3/HP。B超示双肾萎缩。综合患者的病史、临床表现、实验室检查等，考虑诊断为慢性间质性肾炎（B对）。慢性肾盂肾炎（A错）表现为菌尿。糖尿病肾病（D错）有多年糖尿病史。高血压肾损害（E错）患者有多年高血压病史，肾小球滤过功能受损，主要表现为蛋白尿。